桂附理中丸除补肾助阳外，又能
A. 祛暑除湿
B. 补气生津
C. 健脾安神
D. 温中健脾
E. 清暑解毒

正确答案：D。温中健脾

解析：本题考查的是桂附理中丸的功能。桂附理中丸除补肾助阳外，又能温中健脾（D对）。桂附理中丸：【功能】补肾助阳，温中健脾。六合定中丸：【功能】祛暑除湿（A错），和中消食。清暑益气丸：【功能】祛暑利湿，补气生津（B错）。茯苓：【功效】利水渗湿，健脾，安神（C错）。功能为清暑解毒（E错）的中成药，2022年考试指南未明确说明。